男，20岁，农民。发热，头痛，恶心呕吐3天。查体：T：37.8℃，BP：60/40mmHg，脉搏细速，躯干有瘀点，双肾区叩击痛。检查血常规WBC30×10⁹/L，中性0.80，异常淋巴细胞0.10，血小板50×10⁹/L，尿蛋白++。诊断为
A. 流行性脑脊髓膜炎
B. 败血症，感染性休克
C. 流行性肾综合出血热
D. 钩端螺旋体病
E. 传染性单核细胞增多症

正确答案：C。流行性肾综合出血热

解析：20岁男性患者，职业农民（男性青壮年农民高发），发热、头痛、呕吐3天（流行性出血热发热期症状），脉搏细速，躯干有瘀点（流行性出血热发热期体征），尿蛋白（++），双肾区叩击痛（肾功能受损），血WBC30×10⁹/L（成人正常参考值4～10×10⁹/L），中性0.80，异常淋巴细胞0.10（出现异性淋巴细胞），PLT50×10⁹/L（100～300×10⁹/L），根据患者个人史、临床症状和实验室检查，该患者的诊断可能为流行性出血热（C对），流行性出血热的典型表现为发热、出血和肾脏损害，血压低（60/40mmHg）说明进入低血压休克期。流行性脑脊髓膜炎（A错）多见于5岁以下小儿，常表现为高热、寒战、头痛呕吐，皮肤大片瘀斑，脑膜刺激征阳性等，无异常淋巴细胞升高。败血症，感染性休克（B错）临床表现无特异性，可反复出现的畏寒甚至寒战，高热可呈弛张型或间歇型，以瘀点为主的皮疹，累及大关节的关节痛，轻度的肝脾大，重者可有神志改变、心肌炎、感染性休克、DIC、呼吸窘迫综合征等，外周血白细胞升高，各种不同致病菌所引起的败血症，临床特点各不相同。钩体病（D错）常表现为发热、酸痛、全身软、眼红、腿痛、淋巴结肿大，有明显的腓肠肌疼痛，外周血白细胞总数和中性粒细胞轻度增高或正常。传染性单核细胞增多症（E错）发热，颈淋巴结肿大咽痛，肝脾肿大，多形性皮疹，神经系统症状见于少数严重的病例。现将流行性出血热发热期临床表现总结口诀如下：“发热三红醉酒貌，头腰眼痛像感冒，腋下鞭击出血点，恶心呕吐蛋白尿”。